关于心身疾病的治疗原则描述不正确的是
A. 不间断发泄
B. 用支持疗法
C. 进行松弛训练
D. 进行暗示或催眠疗法
E. 行为疗法

正确答案：A。不间断发泄